具有化湿止呕解暑功效的药物是
A. 厚朴
B. 苍术
C. 藿香
D. 佩兰
E. 白豆蔻

正确答案：C。藿香

解析：藿香味辛，性微温，归脾、胃、肺经，其功效为芳香化湿，和中止呕，发表解暑（C对）。厚朴的功效为燥湿，行气，消积，消痰平喘（A错）。苍术的功效为燥湿健脾，祛风散寒，明目（B错）。佩兰的功效为芳香化湿，醒脾开胃，发表解暑（D错）。白豆蔻的功效为化湿行气，温中止呕，开胃消食（E错）。